治疗伤寒、副伤寒流感杆菌性脑膜炎，应首选
A. 多西环素
B. 四环素
C. 链霉素
D. 氯霉素
E. 头孢菌素类

正确答案：D。氯霉素

解析：氯霉素（D对）对革兰阳性菌的抗菌作用高于革兰氏阴性菌，属于抑菌药，但对流感嗜血杆菌、脑膜炎奈瑟菌、肺炎链球菌具有杀灭作用，为伤寒、副伤寒流感杆菌性脑膜炎的首选药。多西环素（A错）作用强度较四环素强，多用于敏感菌所致的呼吸道、泌尿道和胆道感染，也用于斑疹伤寒、恙虫病、支原体肺炎等，还可用于治疗霍乱、预防恶性疟疾和钩端螺旋体感染。四环素（B错）属于快速抑菌剂，对立克次体感染、支原体属感染、衣原体属感染，由于四环素不良反应较严重，已不作为治疗细菌性感染的首选药，目前仅作为鼠疫、霍乱、布鲁菌病、油门螺旋杆菌感染引起的消化性溃疡、肉芽肿鞘杆菌感染引起的腹股沟肉芽肿的首选药。链霉素（C错）抗菌谱较窄。对多数革兰阴性菌作用较强，对结核杆菌作用强，为鼠疫与兔热病的首选。头孢菌素类（E错）属于β-内酰胺类抗生素，不用于伤寒的治疗。